患者，女，20岁。结喉两侧弥漫性肿大，边界不清，皮色如常，无疼痛，诊为气瘿。治疗应首选
A. 海藻玉壶汤
B. 四海舒郁丸
C. 柴胡清肝汤
D. 逍遥散
E. 十全流气饮

正确答案：B。四海舒郁丸

解析：气瘿，是瘿病的一种，因其患部肿块柔软无痛，可随喜怒而消长，故称为气瘿，外因系平素饮水或食物中含碘不足；内因为情志不畅，忧怒无节，气化失调，升降障碍，营运阻塞，本病例已诊断气瘿，本病证候只有肝郁气滞证，治法为疏肝解郁，化痰软坚；方药为四海舒郁丸（B对）。海藻玉壶汤，功用为化痰、软坚、开郁，用于肉瘿、石瘿（A错）。柴胡清肝汤，功用为清肝解郁，用于痈疽疮疡，由肝火而成者（C错）。逍遥散，功用疏肝解郁，调气和血，用于肝郁不舒所致乳癖、失容等（E错）。